硫脲类药物抑制甲状腺激素的合成的说法错误的是
A. 抑制甲状腺过氧化物酶
B. 抑制酪氨酸的碘化
C. 减少甲状腺激素的生物合成
D. 抑制酪氨酸耦联
E. 对已合成的甲状腺激素有效

正确答案：E。对已合成的甲状腺激素有效

解析：硫脲类药物可以抑制甲状腺激素的合成，通过抑制甲状腺过氧化物酶，进而抑制酪氨酸的碘化及耦联，减少甲状腺激素的生物合成。对已合成的甲状腺激素无效。掌握“硫脲类药物”知识点。